腰痛患者，腰痠乏力，喜按喜揉，劳则益甚，卧则痛减，反复发作，伴有口燥咽干，手足心热，舌红少苔，脉细数。其证候是
A. 瘀血
B. 湿热
C. 寒湿
D. 肾阴虚
E. 肾阳虚

正确答案：D。肾阴虚

解析：腰为肾之府，肾主骨髓，肾之精气亏虚，则腰脊失养，故腰痠乏力，喜按喜揉，反复发作，是为虚证所见；劳则气耗，故劳则益甚，卧则痛减；阴虚则阴精不足，虚火上炎，故口燥咽干，手足心热；舌红少苔，脉细数，为阴虚有热之征，故诊断为肾虚腰痛证，偏于肾阴虚（D对）。瘀血腰痛，其特征为腰痛如刺，痛有定处，痛处拒按，日轻夜重（A错）。湿热腰痛，其特征为重着而热，暑湿阴雨天气症状加重，活动后或可减轻(B错)。寒湿腰痛，其特征为腰部冷痛重着，转侧不利，逐渐加重，静卧病痛不减，寒冷和阴雨天则加重（C错）。肾虚腰痛之肾阳虚，其特征为腰部隐隐作痛，酸软无力，缠绵不愈，局部发凉，喜温喜按，遇劳更甚（E错）。